患者女，产后小腹隐隐作痛，喜揉喜按，恶露量少色淡，头晕眼花，大便秘结，舌淡红，苔薄白，脉细弱。方用
A. 加参生化汤
B. 当归建中汤
C. 肠宁汤
D. 芍药甘草场
E. 当归生姜羊肉汤

正确答案：C。肠宁汤

解析：患者产后小腹隐隐作痛，喜揉喜按，恶露量少色淡，是因血虚导致，产时产后失血过多，冲任血虚、胞脉失养，不荣则痛。气虚清阳不得升，则头晕眼花，无力推动则大便秘结（C对）。加参生化汤主治产后一二日，血块痛虽未止，产妇气血虚脱，或晕或厥，或汗多，或形脱，口气渐凉，烦渴不止，或气喘急者（A错）。当归建中汤主治产后虚羸不足，腹中隐痛不已，吸吸少气，或小腹拘急挛痛引腰背，不能饮食者（B错）。芍药甘草场主治津液受损，阴血不足，筋脉失濡所致诸证。方中芍药酸寒，养血敛阴，柔肝止痛；甘草甘温，健脾益气，缓急止痛（D错）。当归生姜羊肉汤治寒疝腹中痛及胁痛里急者；产后腹中㽲痛，腹中寒疝，虚劳不足（E错）。